误服碘酊中毒需洗胃时，宜选用的洗胃液是
A. 硫酸镁溶液
B. 淀粉溶液
C. 植物油
D. 高锰酸钾溶液［1：（5000～10000）］
E. 1%肥皂水

正确答案：B。淀粉溶液

解析：本题考查中毒解救。误服碘酊洗胃时，宜选用的洗胃液是淀粉溶液（B对）。淀粉溶液对中和碘有效，用于碘中毒洗胃，直至洗出液清澈且不显现蓝色为止。对不溶于水的毒物可用适当溶剂清洗，如用10%乙醇或植物油（C错）冲洗酚类中毒，也可用适当的解毒剂加入水中冲洗。高锰酸钾溶液（1：5000-1：10000）（D错）为氧化剂，可破坏生物碱及有机物，常用于巴比妥类、阿片类、士的宁、烟碱、奎宁、毒扁豆碱及砷化物、氰化物、无机磷等药物或毒物中毒。加速毒物排出体外的是导泻、灌肠、利尿、血液净化。导泻：一般用硫酸钠或硫酸镁（A错）适量溶解于水中内服导泻。灌肠：一般用1%微温盐水、1%肥皂水（E错）或清水来加速毒物的排出。利尿：多数毒物进入机体后由肾脏排泄，因此强化利尿是加速毒物排泄的重要措施。血液净化可迅速清除体内毒物，使重症中毒患者的预后大为改观。